Ⅰ型新月体肾炎伴肺出血首选的治疗是
A. 休息和对症处理
B. 单独使用泼尼松
C. 甲泼尼龙冲击联合环磷酰胺治疗
D. 血浆置换
E. 单独使用环孢素

正确答案：D。血浆置换

解析：Ⅰ型新月体肾炎伴肺出血首选的治疗是血浆置换（D对）。急性肾小球肾炎主要治疗以休息和对症处理为主（A错）。微小病变型肾炎90％ 对糖皮质激素敏感，可单独使用糖皮质激素（B错）。甲泼尼龙冲击联合环磷酰胺治疗主要适用于Ⅱ、Ⅲ型，Ⅰ型疗效较差（C错）。环孢素（E错）主要用于器官移植的防止排异反应，自身免疫性疾病等。